牛奶中含量较少的矿物质是
A. 钙
B. 磷
C. 钾
D. 钠
E. 铁

正确答案：E。铁